对于一组服从双变量正态分布的资料，经直线相关分析得相关系数r＝1，则有
A. SS总＝SS残
B. SS残＝SS回
C. SS总＝SS回
D. SS总＞SS回
E. 不能确定SS总和SS回的关系

正确答案：C。SS总＝SS回